可产生抑制性突触后电位的离子基础是
A. K⁺
B. Na⁺
C. Ca²⁺
D. Cl⁻
E. H⁺

正确答案：D。Cl⁻

解析：突触后膜在某种神经递质作用下产生局部超极化电位变化，称为抑制性突触后电位（IPSP）。抑制性突触后电位的产生过程：抑制性中间神经元释放的抑制性递质作用于突触后膜，使后膜中的氯通道开放（D对），引起外向电流，结果使突触后膜发生超极化。虽然抑制性突触后电位（IPSP）的产生还与K⁺（A对）外流，Na⁺（B对）、Ca²⁺（C对）有关，但不是主要因素，因此本题最佳答案为D。